患者死亡，医患双方当事人不能确定死因或者对死因有异议的，应当在患者死亡后法定时限内进行尸检。其法定时限是
A. 12小时内
B. 24小时内
C. 36小时内
D. 48小时内
E. 60小时内

正确答案：D。48小时内

解析：患者死亡，医患双方当事人不能确定死因或者对死因有异议的，应当进行尸检。尸检必须在患者死亡后48小时内（D对）进行，但具备尸体冻存条件的可以延长至7日。